孕妇感染生殖道沙眼衣原体首选的治疗药物是
A. 阿奇霉素
B. 头孢曲松
C. 克林霉素
D. 氧氟沙星
E. 红霉素

正确答案：A。阿奇霉素

解析：妊娠期生殖道沙眼衣原体感染应首选阿奇霉素（A对）。红霉素可透过胎盘屏障，故妊娠妇女慎用。孕妇不宜使用四环素类、喹诺酮类，因可影响胎儿生长发育。